美国学者萨斯和荷伦德根据医生与病人在医疗决策和执行中的地位、主动性将医患关系概括为了
A. 医患关系的二种模式
B. 医患关系的三种模式
C. 护患关系的二种模式
D. 护患关系的三种模式
E. 医、护、患关系的三种模式

正确答案：B。医患关系的三种模式

解析：美国学者萨斯和荷伦德根据医生与病人在医疗决策和执行中的地位、主动性将医患关系归纳为三种类型：主动-被动型、指导-合作型、共同参与型。掌握“医患沟通的理论、技术与其应用以及医患关系模式”知识点。